医疗审慎的内容应除外
A. 医生在医疗各个环节始终做到慎言
B. 医生在医疗各个环节始终做到慎行
C. 医生在医疗各个环节始终做到自我保护
D. 医生在医疗各个环节始终做到精益求精
E. 医生在医疗各个环节始终做到认真负责

正确答案：C。医生在医疗各个环节始终做到自我保护